肾动脉狭窄患者可出现的临床表现是
A. 动脉血压升高，尿量减少
B. 动脉血压降低，尿量减少
C. 动脉血压升高，尿量增加
D. 动脉血压降低，尿量增加
E. 动脉血压和尿量无明显变化

正确答案：A。动脉血压升高，尿量减少

解析：肾动脉狭窄，则有效循环血量增加，动脉血压升高；但有效滤过压降低，由于管球反馈，则表现为尿量减小（A对）。